在设计病例对照研究时，若从全部目标人群中选择病例，则下列哪项说法是错误的
A. 较难进行
B. 要求该人群有完善的疾病登记
C. 选择偏倚较小
D. 其结论推及该人群的可信程度较低
E. 花费较大

正确答案：D。其结论推及该人群的可信程度较低

解析：本题考查病例对照研究选择对照的人群及特点。当设计病例对照研究时，若从全部目标人群中选择病例，则其结论推及到该人群的可信程度较高（D错，为本题正确答案），选择偏倚较小（C对），但该选取方法花费较大（E对），较难进行（A对），同时要求该人群有完善的疾病登记（B对）。